矽肺患者劳动能力鉴定时可分为
A. 4级
B. 3级
C. 7级
D. 2级
E. 6级

正确答案：C。7级

解析：本题考查的是尘肺对劳动能力影响的分级。按《劳动能力鉴定职工工伤与职业病致残等级》（GB/T16180-2014），尘肺致残程度共分7级，从重到轻分别为1～7级（C对ABDE错）。